治疗耳鸣虚证，应选用以下哪组经脉为主
A. 足少阴、手太阳经
B. 足少阳、手少阳经
C. 足少阴、手少阴经
D. 足少阳、手少阴经
E. 足少阴、手少阳经

正确答案：A。足少阴、手太阳经

解析：《医林绳墨·耳》：“耳属少阴肾经，肾之窍也。肾气实，则耳聪；肾气虚，则耳聋。”肾精不足，无以上荣于耳窍，为耳聋虚证之主要病机。故多选用肾经穴位。听宫为手太阳经与手、足少阳经之交会穴，气通耳内，具有聪耳启闭之功，为治耳疾要穴，配手少阳经局部的翳风穴，可疏导少阳经气，宣通耳窍。太溪、肾俞能补肾填精，上荣耳窍。诸穴合用，可治肾精亏虚之耳聋耳鸣（A对）。